肠结核的好发部位
A. 结肠脾曲
B. 结肠肝曲
C. 直肠和乙状结肠
D. 回盲部
E. 全结肠

正确答案：D。回盲部

解析：肠结核主要由结核分枝杆菌引起的，该菌为抗酸菌且对淋巴组织侵袭性较强，因此很少受胃酸影响可顺利到达回盲部，而回盲部富含淋巴组织且肠内容物在此停留时间较久，因此回盲部（D对）易受结核分枝杆菌侵犯，为肠结核好发部位。直肠和乙状结肠（C错）为溃疡性结肠炎好发部位。